利尿剂氢氯噻嗪引起的主要不良反应是
A. 低钾血症
B. 高钾血症
C. 高镁血症
D. 心律失常
E. 踝足肿胀

正确答案：A。低钾血症

解析：本题考查药物的不良反应。利尿剂氢氯噻嗪引起的主要不良反应是低钾血症（A对）。噻嗪类利尿剂可引起低血钾，长期应用者应定期监测血钾，并适量补钾。高钾血症（B错）是醛固酮受体阻断剂螺内酯的主要不良反应。踝足肿胀（E错）是钙通道阻滞剂的典型不良反应。